如遇一位异种动物血清过敏者（仍需注破伤风抗毒素）应当如何处理
A. 停止注射
B. 用色甘酸二钠后再注射
C. 少量多次注射
D. 一次性皮下注射
E. 与肾上腺素同时注射

正确答案：C。少量多次注射